女，30岁，尿频、尿痛、腰部胀痛3天。T37.4℃。此时最有助于鉴别肾盂肾炎与膀胱炎的化验检查结果是
A. 尿培养及菌落计数阳性
B. 尿涂片革兰染色发现细菌
C. 尿有蛋白及白细胞
D. 尿中有脓细胞
E. 尿常规见白细胞及白细胞管型

正确答案：E。尿常规见白细胞及白细胞管型

解析：最有助于鉴别肾盂肾炎与膀胱炎的化验检查结果是尿常规见白细胞及白细胞管型（E对），尿中发现白细胞管型提示肾盂肾炎。